关于半数致死剂量叙述正确的是
A. 半数致死剂量是一个统计学数值，能够全面反映外源化学物的毒性特征
B. 半数致死剂量只与毒物本身和实验动物有关
C. 半数致死剂量越大，表示毒物毒性越弱
D. 表示半数致死剂量时，必须注明染毒时间

正确答案：C。半数致死剂量越大，表示毒物毒性越弱

解析：本题考查半数致死剂量的相关内容。半数致死剂量是指毒物引起一半受试对象死亡所需要的剂量。它是一个经过统计处理计算得到的数值，常用以表示和比较急性毒性的大小（A错）。半数致死剂量数值越小，表示外源化学物的毒性越强，反之半数致死剂量数值越大，则毒性越低（C对）。半数致死剂量受诸多因素的影响，如实验动物种属、实验条件等（B错）。表示半数致死剂量时，不需注明染毒时间（D错）。